男性，46岁，近2年反复上腹不适，胀痛，暖气。无反酸。查体：上腹轻压痛，胃镜：胃窦黏膜红白相间，以白为主，下列不宜食用的食物
A. 腌制食品
B. 油腻食品
C. 面制食品
D. 纤维食品
E. 豆制品

正确答案：A。腌制食品

解析：慢性萎缩性胃炎: 本病以胃黏膜萎缩变薄 ，黏膜腺体减少或消失伴有肠上皮化生，固有层内多量淋巴细胞、浆细胞浸润，出现胃窦黏膜红白相间，以白为主等特点 ，故诊断为慢性萎缩性胃炎。不宜食用腌制食品（A对）。